女，72岁。不慎摔伤右髋部。查体：右下肢短缩，外旋50°畸形，右髋肿胀不明显，但有叩痛。该患者最容易出现的并发症是
A. 脂肪栓塞
B. 坐骨神经损伤
C. 髋内翻畸形
D. 股骨头缺血性坏死
E. 髋关节周围创伤性骨化

正确答案：D。股骨头缺血性坏死